下列不是全球伤害的流行病学分布特征的选项是
A. 全球死亡的1/10是伤害致死
B. 伤害死亡的高发年龄为15～59岁
C. 伤害死亡中女性占2/3
D. 伤害的死亡原因主要是交通事故等
E. 儿童、青少年伤害死亡呈上升趋势

正确答案：C。伤害死亡中女性占2/3

解析：本题考查伤害的全球流行特征。不同年龄人群伤害的发生率与死亡率有着各自不同的分布特点，大多数伤害的发生率和死亡率均为男性高于女性，15～64岁年龄段，女性的伤害死亡率约为男性的1/3；65岁以后，女性的伤害死亡率大约是男性的一半（C错，为本题正确答案）。全球死亡的1/10是伤害致死（A对）；伤害死亡的高发年龄为15～59岁（B对）；伤害的死亡原因主要是交通事故等（D对）；儿童、青少年伤害死亡呈上升趋势（E对）均是伤害的全球流行特征。